以下不是淋病奈瑟球菌致病物质的是
A. 菌毛
B. 荚膜
C. 脂寡糖
D. IgA1蛋白酶
E. 外膜蛋白

正确答案：B。荚膜

解析：淋病奈瑟球菌致病物质：①菌毛：它与细胞表面受体结合，使淋病奈瑟菌更易附着在人泌尿生殖道上皮细胞、精子、红细胞及白细胞上。②脂寡糖（LOS）：由外膜的脂质A与核心寡糖构成，类似于脂多糖（LPS）的内毒素作用。③IgA1蛋白酶：破坏黏膜细胞表面的特异性SIgA1，使细菌在黏膜上及黏膜下大量增殖，引起泌尿生殖系统感染。④外膜蛋白：具有破坏宿主黏膜上皮细胞膜结构，介导细菌黏附于上皮细胞和阻抑杀菌抗体的作用。掌握“肠球菌属及奈瑟菌属”知识点。